以下药物的鉴别反应是：苯甲酸
A. 在酸性条件下，和亚硝酸钠与β-萘酚反应，显橙红色
B. 在碳酸钠试液中，与硫酸铜反应，生成蓝紫色配合物
C. 与硝酸反应，显黄色
D. 加入三氯化铁试液，显紫红色
E. 加入三氯化铁试液，生成色沉淀

正确答案：E。加入三氯化铁试液，生成色沉淀

解析：本题考查中国药典的凡例。试验中供试品或试药等“称重”或“量取”的量均以阿拉伯数码表示，其精确度可根据数值的有效位数来确定。如称取“2g”指称取重量可为1.5～2.5g（A对）。当称取重量为“2.0g”，指称取重量可为1.95～2.05g（C错）。当规定取用量为“约”若干时，系指取用量不得超过规定量的±10%（B错）。“称定”系指称取重量应准确至所取重量的百分之一（D错）。“精密称定”指称取重量应准确至所取重量的千分之一（E错）。